关于三羧酸循环的酶，叙述正确的是
A. 主要位于线粒体外膜
B. Ca²⁺可抑制其活性
C. 当NADH/NAD⁺比值增高时活性较高
D. 氧化磷酸化的速率可调节其活性
E. 在血糖较低时，活性较低

正确答案：D。氧化磷酸化的速率可调节其活性